下列食物在胃中排空速度由快到慢依次是
A. 蛋白质、脂肪、糖
B. 脂肪、糖、蛋白质
C. 糖、蛋白质、脂肪
D. 蛋白质、糖、脂肪
E. 糖，脂肪、蛋白质

正确答案：C。糖、蛋白质、脂肪